《中国药典》规定，以二苯乙烯苷和结合蒽醌为指标成分进行含量测定的药材是
A. 何首乌
B. 丹参
C. 芦荟
D. 紫草
E. 决明子

正确答案：A。何首乌

解析：本题考查的是何首乌的化学成分。《中国药典》规定，以二苯乙烯苷和结合蒽醌为指标成分进行含量测定的药材是何首乌（A对）。何首乌的主要成分为蒽醌类成分，以大黄素、大黄酚、大黄素甲醚、大黄酸、芦荟大黄素等为主，《中国药典》以二苯乙烯苷和结合蒽醌为指标成分进行含量测定，要求何首乌含二苯乙烯苷不得少于1.0%，制何首乌含二苯乙烯苷不得少于0.70%；对何首乌和制何首乌要求结合蒽醌均不得少于0.10%（以大黄素和大黄素甲醚计）。丹参（B错）的化学成分主要包括脂溶性成分和水溶性成分两大部分。脂溶性成分大多为共轭醌、酮类化合物。如丹参酮Ⅰ、丹参酮ⅡA、丹参酮ⅡB、隐丹参酮等。《中国药典》采用高效液相色谱法测定丹参中丹参酮类和丹酚酸B的含量，要求丹参酮ⅡA、隐丹参酮和丹参酮Ⅰ的总量不得少于0.25%，丹酚酸B不得少于3.0%。另外，水溶性成分则包括丹参素，丹参酸A、丹酚酸B，原儿茶酸，原儿茶醛等。芦荟（C错）中主要活性成分是羟基蒽醌类衍生物，包括芦荟大黄素、大黄酸、大黄素、大黄酚、大黄素甲醚等。《中国药典》以芦荟苷为指标成分进行含量测定，芦荟苷含量不得少于16.0%。紫草（D错）的主要化学成分为萘醌类化合物，包括乙酰紫草素、欧紫草素、紫草素、β,β'-二甲基丙烯酰紫草素、β,β'-二甲基丙烯酰欧紫草素、去氧紫根素等。《中国药典》采用紫外分光光度法测定药材中羟基萘醌总含量，以左旋紫草素计，不得少于0.80%，采用高效液相色谱法测定药材中β,β'-二甲基丙烯酰阿卡宁（β,β'-二甲基丙烯酰欧紫草素）的含量，不得少于0.30%。决明子（E错）中含有蒽醌类、萘并吡咯酮类、脂肪酸类等化学成分。其中，蒽醌类化合物为其主要成分，含量约1%，主要为大黄酚、大黄素甲醚、决明素、橙黄决明素、黄决明素、美决明素、葡萄糖美决明素、葡萄糖橙黄决明素。《中国药典》以大黄酚、橙黄决明素为指标成分进行含量测定，含量分别不得少于0.20%和0.80%。